腭裂手术时在腭部黏骨膜下注射含肾上腺素的麻药或生理盐水的主要目的是
A. 减少疼痛
B. 减少出血、便于剥离
C. 减少肿胀
D. 防止血管损伤
E. 以上都不是

正确答案：B。减少出血、便于剥离

解析：本题考查腭裂手术时在腭部黏骨膜下注射含肾上腺素的麻药或生理盐水的目的。肾上腺素有收缩血管的作用，因此手术时常用于加入局麻药中以减少出血，腭部无黏膜下层，黏膜与骨膜结合紧密，称为黏骨膜，在手术时很难剥离，因此将局麻药打入骨膜下可以使黏骨膜便于剥离（B对）。对于减少疼痛（A错），减少肿胀（C错）也有一定的效果，但不是其主要目的。防止血管损伤（D错）要靠控制切口位置的准确性，与麻药的注射无关。